根据《药品经营许可证管理办法》，开办药品批发企业必须具有大学以上学历且为执业药师的岗位是
A. 市场部负责人
B. 企业负责人
C. 质量负责人
D. 药品检验部门负责人
E. 质量管理员

正确答案：C。质量负责人

解析：本题考查的是药品批发企业开办条件。根据《药品经营许可证管理办法》，开办药品批发企业必须具有大学以上学历且为执业药师的岗位是质量负责人（C对）。药品批发企业企业质量负责人：具有大学本科以上学历、执业药师资格和3年以上药品经营质量管理工作经历，在质量管理工作中具备正确判断和保障实施的能力。药品批发企业企业负责人（B错）：具有大学专科以上学历或者中级以上专业技术职称，经过基本的药学专业知识培训，熟悉有关药品管理的法律法规及药品GSP。药品批发企业质量管理工作人员（E错）：具备药学中专或者医学、生物、化学等相关专业大学专科以上学历或者具有药学初级以上专业技术职称。